躯干、四肢皮肤痛、温觉传导通路的第二级神经纤维交叉于
A. 脊髓的白质前连合
B. 脑干的锥体交叉
C. 脑干的三叉丘系交叉
D. 内侧丘系交叉
E. 无

正确答案：A。脊髓的白质前连合

解析：躯干、四肢皮肤痛温觉传导通路的第2级神经纤维交叉于脊髓的白质前连合（A对）。四肢、躯干运动传导通路的神经纤维交叉于脑干的锥体交叉（B错）。头面部痛温觉、触压觉传导通路的第2级神经纤维交叉于脑干的三叉丘系交叉（C错）. 躯干、四肢意识性本体感觉、精细触觉传导通路中的第2级神经纤维交叉于内侧丘系交叉（D错）。